只在感染根管内出现的牙髓感染的特有病原菌是
A. 牙髓卟啉菌
B. 牙龈卟啉菌
C. 梭形杆菌
D. 消化链球菌
E. 韦荣球菌

正确答案：A。牙髓卟啉菌

解析：本题考查只在感染根管内出现的牙髓感染的特有病原菌。牙髓卟啉菌几乎只出现在感染根管内，是牙髓感染的特有病原菌（A对）。牙龈卟啉单胞菌是牙周病，尤其是慢性牙周炎病变区最主要的优势菌（B错）。梭形杆菌和消化链球菌在根尖周脓肿内也可被检测出，且检出率较高（CD错）。韦荣球菌是感染根管中较常见的优势菌之一，但不是特有的病原菌（E错）。